初产妇，26岁。孕39周，肛查宫口8cm，先露S=0，胎膜未破，头先露，有宫缩，但子宫体部不变硬，持续时间30秒，间隔5分钟，胎心136次/分，B型超声示胎儿双顶径为9.0cm。出现以上情况最可能的是
A. 子宫收缩过强
B. 胎儿过大
C. 子宫收缩乏力
D. 骨盆狭窄
E. 胎儿畸形

正确答案：C。子宫收缩乏力

解析：青年初产妇，孕39周（妊娠28周及以后为妊娠晚期），宫口开大8cm，说明处于第一产程活跃期（活跃期是指宫口扩张3～10cm），第一产程活跃期正常应为宫缩50～60秒，间歇2～3分钟。本例有宫缩持续时间为30秒（正常为50～60秒），间隔5分钟（正常为2～3分钟），宫缩时宫体部不硬，应诊断为协调性宫缩乏力（收缩力弱，持续时间短，间歇期长且不规律）（C对）。子宫收缩过强（A错）表现为子宫强烈收缩，可失去节律性，收缩过频，宫缩无间歇（P190）。胎儿双顶径为9.0cm，属于正常范围，不属于胎儿过大（B错）。胎儿大小正常，宫口已开大8cm，胎头已达坐骨棘平面，根据题中条件不能诊断为骨盆狭窄（D错）。胎儿畸形与题干所述无关（E错）。